肾为气之根，主要指的是
A. 肾为五脏阳气的根本
B. 主水液的蒸腾气化作用
C. 主膀胱的气化开合作用
D. 摄纳肺吸入清气的作用
E. 为一身气化功能的根本

正确答案：D。摄纳肺吸入清气的作用

解析：该题主要考查肾主纳气的生理功能。肾为气之根体现肾主纳气的生理功能（D对）主水液的蒸腾气化作用体现的是肾主水的生理功能（B错）。肾阳为脏腑阳气之本，“五脏之阳气，非此不能发”，推动和激发脏腑的各种功能，温煦全身脏腑形体官窍，肾阴、肾阳统称为“五脏阴阳之根本”（A错）。《类证治裁·喘证》说：“肺为气之主，肾为气之根”故肺为一身气化功能的根本（E错）。